属于四环类抗抑郁药的是
A. 氯米帕明
B. 吗氯贝胺
C. 马普替林
D. 曲唑酮
E. 丙米嗪

正确答案：C。马普替林

解析：本题考查四环类抗抑郁药。马普替林（C对）为四环类抗抑郁药。氯米帕明（A错）、丙米嗪（E错）为三环类抗抑郁药。吗氯贝胺（B错）为单胺氧化酶抑制剂。曲唑酮（D错）为5-羟色胺受体阻断剂。